颅底骨折的诊断主要依靠
A. 病史
B. 临床表现
C. X线摄片
D. B超
E. CT

正确答案：B。临床表现

解析：颅底骨折诊断主要依靠其临床表现（B对），如耳、鼻出血或脑脊液漏、脑神经损伤、皮下或粘膜下淤血斑。病史（A错）颅底骨折大多由颅盖骨折延伸而来，少数可因头部挤压伤或着力部位于颅底水平的外伤所致，有诊断价值，但意义不大。X线摄片（C错）对颅底骨折的诊断价值有限。B超（D错）用于脑部软组织病变检查。CT（E错）通过对窗宽和窗距的调节（骨窗相）常能显示骨折部位，还能发现颅内积气，对颅底骨折有诊断意义，但不作为主要诊断依据。